D-洋地黄毒糖是
A. 2-氨基糖
B. 6-氨基糖
C. 3-去氧糖
D. 3，4-二去氧糖
E. 2，6-二去氧糖

正确答案：E。2，6-二去氧糖

解析：本题考查的是强心苷中糖部分的结构特征。D-洋地黄毒糖是2，6-二去氧糖（E对）。α-去氧糖常见于强心苷类，是区别于其他苷类成分的一个重要特征。强心苷中普遍具有α-去氧糖，如D-洋地黄毒糖等2，6-二去氧糖；L-夹竹桃糖、D-加拿大麻糖、D-迪吉糖和D-沙门糖等2，6-二去氧糖甲醚。